子宫圆韧带
A. 由腹膜构成
B. 起于子宫颈
C. 不经过腹股沟管
D. 止于耻骨联合
E. 是维持子宫前倾的重要结构

正确答案：E。是维持子宫前倾的重要结构

解析：子宫圆韧带平滑肌和结缔组织构成（A错），起于子宫体前面的上外侧，输卵管子宫口的下方（B错）,经过腹股沟管（C错），止于阴阜和大阴唇前端（D错），是维持子宫前倾的重要结构（E对）。